慢性唇炎的病因可能是下列因素，除了
A. 天气干燥
B. 咬唇不良习惯
C. 心情烦躁、多虑
D. 空气寒冷
E. 残根残冠刺激

正确答案：E。残根残冠刺激

解析：慢性唇炎的病因多与各种慢性长期持续性刺激有关，如干燥、寒冷、舔唇、咬唇、撕皮等不良习惯及日晒、烟酒、化妆品刺激等，与精神因素也有一定的关系。掌握“慢性非特异性唇炎”知识点。